在某特定时间内总人口中某病新旧病例数所占的比例
A. 发病率
B. 死亡率
C. 罹患率
D. 病死率
E. 患病率

正确答案：E。患病率